一巨幼细胞贫血患儿肌内注射维生素B₁₂，一次25㎍～50㎍，应抽取0.5mg/ml的药液
A. 0.025m1～0.05ml
B. 0.05ml～0.10ml
C. 0.10m1～0.20ml
D. 0.15ml～0.30m1
E. 0.20m1～0.40ml

正确答案：B。0.05ml～0.10ml

解析：本题考查药学计算。根据0.1mg=100㎍，可知药液浓度为0.5mg/ml=0.5×100=500㎍/ml。若一次25㎍，则应抽取药液体积=25㎍÷500㎍/ml=0.05ml；若一次50㎍，则应抽取药液体积=50㎍÷500㎍/ml=0.10ml，即应抽取的药液体积范围是0.05ml～0.10ml（B对）。